营养不良患儿最早出现的临床表现是
A. 皮下脂肪减少
B. 体重不增
C. 消瘦
D. 肌肉松弛
E. 运动和智能发育落后

正确答案：B。体重不增

解析：本题考查营养不良患儿最早出现的临床表现。营养不良患儿最早出现的临床表现是体重不增（B对），随营养不良加重,体重逐渐下降，主要表现为消瘦（C错）。皮下脂肪层厚度是判断营养不良程度的重要指标之一。皮下脂肪消耗的顺序先是腹部，其次为躯干、臀部、四肢，最后为面额。皮下脂肪逐渐减少（A错）以致消失，皮肤干燥、苍白、渐失去弹性，额部出现皱纹，肌张力渐降低、肌肉松弛（D错）、肌肉萎缩呈“皮包骨”时，四肢可有挛缩。营养不良患儿一般不会出现运动和智能发育落后（E错）。